男，28岁，突起寒颤，高热，恶心，呕吐腰痛已5天。体检：重病容，眼睑浮肿，球结膜及胸部皮肤充血，腋下见少许点状出血点，血压70/50mmHg，怀疑流行性出血热。本例必须首先考虑的治疗措施是
A. 使用升压药
B. 补充血容量
C. 纠正酸中毒
D. 小剂量肝素抗DIC
E. 选用抗病毒治疗

正确答案：B。补充血容量

解析：28岁男性患者，根据患者临床症状和体征，初步诊断为流行性出血热，发病5天，血压70/50mmHg，属于低血压休克期，为血管通透性增加，血浆丢失所致，实质是血容量减少，组织灌注不足，故首要的治疗措施为补充血容量（B对），同时注意纠正酸中毒和改善微循环，应早期、快速、适量补液，争取4小时内稳定血压。升压药（A错）一般在补足血容量后才能再使用。休克早期不宜使用碱性药物纠正酸中毒（C错），以免氧解离曲线左移，加重组织缺氧。小剂量肝素防治DIC（D错），为肾综合征出血热的治疗措施之一，非本例必须首先考虑的治疗措施。抗病毒治疗（E错）仅用于发热期患者，能抑制病毒繁殖，减轻病情，缩短病程。